由宫颈上皮内瘤变3级发展至浸润癌的时间
A. 2年
B. 3～5年
C. 5～10年
D. 10～15年
E. 15～20年

正确答案：C。5～10年

解析：宫颈上皮内瘤变（CIN）（八版病理学P285）包括子宫颈上皮异型增生和原位癌。宫颈上皮内瘤变Ⅲ级（CINⅢ）在10年内（C对）发展为浸润癌的几率则高达20%。